喹诺酮类抗菌药抑制
A. 细菌二氢叶酸合成酶
B. 细菌二氢叶酸还原酶
C. 细菌RNA多聚酶
D. 细胞依赖于DNA的RNA多聚酶
E. 细菌DNA回旋酶

正确答案：E。细菌DNA回旋酶